对动脉内皮有保护作用的药物是
A. 烟酸
B. 洛伐他汀
C. 考来烯胺
D. 氯贝丁酯
E. 硫酸软骨素、硫酸乙酰肝素、硫酸皮肤素复合物

正确答案：E。硫酸软骨素、硫酸乙酰肝素、硫酸皮肤素复合物